异丙嗪不具备的药理作用是
A. 镇静作用
B. 减少胃酸分泌
C. 抗胆碱作用
D. 局麻作用
E. 止吐作用

正确答案：B。减少胃酸分泌

解析：异丙嗪可作用于胃肠道平滑肌H₁受体，拮抗组胺对胃肠道平滑肌的收缩或挛缩，不能减少胃酸分泌（B错，为本题正确答案）。异丙嗪属于第一代H₁受体阻断药，对H₁受体有亲和力，但无内在活性，可竞争性阻断H₁受体，有镇定催眠作用（A对），可能是由于间接降低了脑干网状上行激活系统的应激性。异丙嗪通过中枢性抗胆碱性能（C对），阻断前庭核区胆碱能突触迷路冲动的兴奋，作用于前庭和呕吐中枢及中脑髓质感受器，可用于抗晕动症。异丙嗪皮下注射作局部麻醉（D对），用于麻醉和手术前后的辅助治疗。异丙嗪可抑制延髓的催吐化学感受区，发挥止吐作用（E对）。